生化汤的组成药物是
A. 当归、川芎、桃仁、炮姜、炙甘草
B. 当归、川芎、桃仁、赤芍、炙甘草
C. 当归、川芎、生地、白芍、炙甘草
D. 当归、川芎、桃仁、红花、益母草
E. 当归、川芎、红花、赤芍、益母草

正确答案：A。当归、川芎、桃仁、炮姜、炙甘草

解析：生化汤功能养血祛瘀，温经止痛，由当归、川芎、桃仁、炮姜、炙甘草组成（A对）。